哪种病人死亡后必须将尸体立即消毒，就近火化
A. 鼠疫、霍乱和炭疽病人
B. 甲类传染病人和病原携带者、乙类传染病病人中的传染性非典型肺炎病人，炭疽中的肺炭疽病人
C. 对疑似甲类传染病病人
D. 乙类或者丙类传染病病人
E. 肝硬化病人

正确答案：A。鼠疫、霍乱和炭疽病人

解析：本题考查传染病预防与控制。死亡后必须将尸体立即消毒，就近火化的病人为鼠疫、霍乱和炭疽病人（A对），因其传染性强，病死率高。甲类传染病人和病原携带者、乙类传染病病人中的传染性非典型肺炎病人，炭疽中的肺炭疽病人（B错）须予以隔离治疗。对疑似甲类传染病病人（C错）在明确诊断前，在指定场所进行医学观察。乙类或者丙类传染病病人（D错）须根据病情，采取必要的治疗和控制传播措施。肝硬化病人（E错）须采取血液-体液隔离，以切断传播途径。